某温度计厂工人，近2年来有全身乏力，出现记忆力减退等神经症状，常发怒，急躁，而后又抑郁胆怯，近几日发现写的字迹弯曲，该工人可能患
A. 慢性铅中毒
B. 慢性苯中毒
C. 慢性汞中毒
D. 急性汞中毒
E. 急性锰中毒

正确答案：C。慢性汞中毒